可与酶的必需基团结合，影响酶活性的是
A. 底物浓度
B. 酶浓度
C. 激活剂
D. pH
E. 抑制剂

正确答案：E。抑制剂